浆膜下子宫肌瘤最常见的症状体征是
A. 月经量过多
B. 血性白带
C. 痛经
D. 继发性贫血
E. 下腹部包块

正确答案：E。下腹部包块

解析：浆膜下肌瘤向外突出，腹部包块的表现明显，经量增多及经期延长是因为宫腔增大，子宫内膜面积增加，这种情况主要见于肌壁间肌瘤及粘膜下肌瘤者。ABCD四个答案是黏膜下肌瘤和肌壁间肌瘤的常见症状。掌握“子宫肌瘤”知识点。